患者面色萎黄，头晕眼花，四肢倦怠，气短少言，心悸不安，食欲减退，舌淡苔白，脉细弱。治疗应首选
A. 四物汤
B. 归脾汤
C. 当归补血汤
D. 四君子汤
E. 八珍汤

正确答案：E。八珍汤

解析：患者面色萎黄，头晕眼花，四肢倦怠，气短少言，心悸不安，食欲减退，舌淡苔白，脉细弱。由气血两虚证多由久病失治、或病后失调、或失血过多而致。方用八珍汤。人参、熟地益气养血；白术、茯苓健脾渗湿，助人参益气补脾；当归、白芍养血和营，助熟地滋养心肝；川芎活血行气；甘草益气和中，调和诸药，姜、枣调和脾胃，以资生化气血（E对）。四物汤是补血调经的主方（A错）。归脾汤方证因思虑过度，劳伤心脾，气血亏虚所致。为治疗心脾气血两虚的常用方（B错）。当归补血汤证为劳倦内伤，血虚气弱，阳气浮越所致。为补气生血的基础方（C错）。四君子汤由脾胃气虚，运化乏力所致。为治疗脾胃气虚的常用方，亦是补气的基础方（D错）。